女，30岁。体检发现胆囊结石2年。近期进食油腻食物后持续上腹痛，向右肩部放射，伴恶心、呕吐，休息后可自行缓解，症状反复发作。查体：上腹明显压痛，Murphy征可疑阳性，肋脊角无压痛、叩痛。若患者确诊为该疾病，诊疗方案是
A. 禁食水，持续胃肠减压，给予生长抑素持续泵入
B. 体外超声波碎石
C. 给予抗酸，抗炎治疗
D. 腹腔镜胆囊切除术
E. 通便灌肠

正确答案：D。腹腔镜胆囊切除术

解析：青年女性，既往胆囊结石病史，近期进食油腻食物后持续上腹痛，向右部放射，伴恶心、呕吐，休息后可自行缓解（胆囊结石的典型表现），症状反复发作，查体：上腹明显压痛，Murphy征可疑阳性，肋脊角无压痛、叩痛（可排除肾结石），根据患者的病史、临床症状及体征，考虑最可能的诊断为胆囊结石，该患者症状反复发作，诊疗方案是腹腔镜胆囊切除术（D对），禁食水，持续胃肠减压，给予生长抑素持续泵入（A错）主要用于伴发急性胆囊炎的一般治疗。迄今尚无证据表明其他非手术疗法能完全溶解或排尽结石（B错）。该患者没有明显的炎症表现，所以目前无需抗酸，抗炎治疗（C错）。通便灌肠（E错）主要用于便秘排便困难的患者。